S蛋白
A. 是C3转化酶
B. 是C5转化酶
C. 可阻断C3转化酶形成
D. 可损伤细胞
E. 可阻止膜攻击复合物形成

正确答案：E。可阻止膜攻击复合物形成